肺的通调水道功能主要依赖于
A. 肺主一身之气
B. 肺司呼吸
C. 肺主宣发和肃降
D. 肺朝百脉
E. 肺合皮毛

正确答案：C。肺主宣发和肃降

解析：肺的通调水道的过程包括：肺气宣发，将脾转输至肺的津液，向上向外布散，上至头面诸窍，外达皮毛肌腠，并化为汗液排出体外。肺气肃降，将脾转输至肺的津液，向下向内输送到其他脏腑，并将各脏腑代谢后产生的浊液下输膀胱，称为尿液生成之源（C对）。肺主一身之气（A错）指肺主司一身之气的生成和运行的机能。肺主一身之气的运行，体现于对全身气机的调节作用；肺司呼吸（B错）指肺有吸清呼浊，进行气体交换的机能，肺是气体交换的场所，通过肺气的宣发与肃降运动，吸入清气，排出浊气，吐故纳新，实现机体与外界环境之间的气体交换，以维持生命活动；肺朝百脉（D错）是指肺具有辅心行血于周身的生理机能。全身的血液，通过血脉而流经于肺，经肺的呼吸进行气体交换，而后运行于全身；肺合皮毛（E错）是肺与皮毛之间存在着相互为用的关系，皮毛为一身之表，具有防御外邪，调节津液代谢与体温，以及辅助呼吸的作用。